属于第三代头孢菌素，通常铜绿假单胞菌对其敏感的药物是
A. 阿米卡星
B. 氨曲南
C. 氨苄西林
D. 头孢他啶
E. 头孢曲松

正确答案：D。头孢他啶

解析：本题考查抗菌药物。属于第三代头孢菌素，通常铜绿假单胞菌对其敏感的药物是头孢他啶（D对）。头孢曲松（E错）也属第三代头孢菌素，但对铜绿假单胞菌作用不及头孢他啶。阿米卡星（A错）属于氨基糖苷类药物，浓度依赖型，通常铜绿假单胞菌对其敏感。氨曲南（B错）仅对需氧革兰阴性菌有效，可以作为氨基糖苷类药物的替代品。氨苄西林（C错）为半合成的青霉素，作用特点是广谱，不耐青霉素酶。